食源性疾病最常见的致病因素是
A. 细菌及其毒素
B. 真菌
C. 病毒
D. 重金属
E. 放射性物质

正确答案：A。细菌及其毒素